病毒的体外细胞培养可见细胞变性死亡形成空斑，称作
A. 细胞坏死
B. 细胞凋亡
C. 细胞病变效应
D. 细胞变异
E. 细胞分化

正确答案：C。细胞病变效应

解析：病毒的体外细胞培养可见细胞变性死亡形成空斑，称作细胞病变效应。掌握“病毒传播方式、感染类型、致病机制及免疫”知识点。